灰黄霉素首选用于
A. 股藓
B. 体藓
C. 头藓
D. 手藓
E. 足藓

正确答案：C。头藓